深秋之季，当选下列哪项食品
A. 海鲜韭菜
B. 山药辣椒
C. 蜂蜜泥鳅
D. 狗肉核桃仁
E. 苦瓜花生

正确答案：C。蜂蜜泥鳅

解析：秋季节气干燥，应当多进食些滋润味甘淡的食品，如蜂蜜等。秋天适宜进补，吃泥鳅可起到益气壮阳的功效（C对）。韭菜性温，属于热性，可祛寒散淤、滋阴壮阳，初春时节吃最好。冬令是进补的时节，“春夏养阳，秋冬养阴”，海鲜可作为则冬季清补的药膳材料之一（A错）。山药效温，味甘，平。若脾胃虚弱，最合适在夏秋季节吃。春天，是万物生发的季节，人应顺应天地生发之趋势，多吃些生发的食物。比如辣椒（B错）。狗肉能滋补血气、暖胃祛寒，可驱寒保暖，增强人体的抗寒能力，特别适合冬季食用。冬季属黑，是补肾养肾的季节，因此冬季应当多食用一些有益肾气、补肾强肾的食物，如核桃仁（D错）。苦瓜适合于长夏季节食用，因为长夏湿热交蒸，湿热困脾，易导致食欲不振、倦怠乏力等。苦瓜性寒可以清热，苦可燥湿，可以通畅脾胃气机，增进食欲。花生滋腻甘甜，辛香醒脾，冬季适当进食花生，有不错的健脾之功（E错）。